按药品不良反应新分类方法，注射液中微粒引起的血管栓塞属于
A. D类反应（给药反应）
B. A类反应（扩大反应）
C. F类反应（家族性反应）
D. B类反应（过度反应）
E. G类反应（基因毒性反应）

正确答案：A。D类反应（给药反应）

解析：本题考查药品不良反应的分类。按药品不良反应新分类方法，注射液中微粒引起的血管栓塞属于D类反应（给药反应）（A对）。D型反应（给药反应）是由药物特定的给药方式引起的不良发应。如植入药物周围的炎症或纤维化、注射液中微粒引起的血栓形成或血管栓塞等。A类反应（B错）是药物对人体呈剂量相关的反应，它是不良反应中最常见的类型。F类反应（C错）又叫家族性反应，是由家族性遗传疾病引起的不良发应。B类反应（过度反应）（D错）是指促进某些微生物生长引起的不良反应。可预测，作用于微生物而不是人体。如抗生素引起的肠道内耐药菌群的过度生长。G类反应（基因毒性反应）（E错）即药物损伤基因、出现致癌、致畸等不良反应。